心肌收缩完毕后，产生正常舒张的首要因素是
A. 胞浆Ca²⁺浓度迅速下降
B. 胞浆Ca²⁺浓度迅速上升
C. 细胞外Ca²⁺迅速内流
D. 肌钙蛋白与Ca²⁺迅速结合
E. 肌钙蛋白与Ca²⁺迅速解离

正确答案：A。胞浆Ca²⁺浓度迅速下降

解析：心肌收缩后，产生正常舒张的首要因素是胞浆Ca²⁺浓度迅速下降（A对BC错），使Ca2+迅速与肌钙蛋白解离（心肌兴奋－收缩耦联的关键是Ca2+和肌钙蛋白结合），中止兴奋-收缩耦联过程。